关于碱性磷酸酶测定的临床意义错误的是
A. 阻塞性黄疸患者LP明显增高
B. 肝细胞性黄疸ALP轻度增高
C. 肝内局限性胆道阻塞ALP明显增高
D. 骨骼疾病时ALP不增高
E. 肝内胆汁淤积ALP明显升高

正确答案：D。骨骼疾病时ALP不增高

解析：碱性磷酸酶是肝脏疾病常用实验室检测，血清中以游离形式存在，由于大部分ALP来源于肝脏和骨骼，因此常作为肝脏疾病的检查指标之一，病理情况下，血清ALP升高主要有以下原因：（1）肝脏系统疾病如胰头癌、胆道结石引起的胆管阻塞，肝内胆汁淤积（E对）等；（2）黄疸的鉴别诊断：①阻塞性黄疸（A对），ALP和血清胆红素明显升高；②肝细胞性黄疸（B对），血清胆红素中毒增加，ALP轻度升高；③肝内局限性胆道阻塞（C对），ALP明显增高。（3）骨骼疾病（D错，为本题正确答案）；（4）其他：营养不良。